广谱抗心律失常药是
A. 利多卡因
B. 普萘洛尔
C. 胺碘酮
D. 奎尼丁
E. 普鲁帕酮

正确答案：C。胺碘酮